鼻咽侧壁上的结构是
A. 咽鼓管咽口
B. 腭扁桃体
C. 扁桃体上窝
D. 梨状隐窝
E. 会厌谷

正确答案：A。咽鼓管咽口

解析：咽鼓管咽口(A对)位于鼻咽部的侧壁上，腭扁桃体(B错)位于口咽侧壁上，扁桃体上窝(C错)位于口咽侧壁的扁桃体窝上部，梨状隐窝(D错)位于喉咽部，会厌谷(E错)位于口咽舌会厌正中襞两侧。